某男，57岁。神疲乏力，少气懒言，自汗；舌质淡，苔薄白，脉虚。医生辨证为虚劳气虚证，应选用的中成药是
A. 四物颗粒
B. 四神丸
C. 四君子丸
D. 龟鹿二仙膏
E. 六味地黄丸

正确答案：C。四君子丸

解析：本题考查的是虚劳的辨证论治。辨证为虚劳气虚证，应选用的中成药是四君子丸（C对）。虚劳又称虚损，是以脏腑亏损、气血阴阳虚衰，久虚不复成劳为主要病机，以五脏虚证为主要临床表现的多种慢性虚弱证候的总称。（一）气虚证：【方剂应用】基础方剂为四君子汤（人参、白术、茯苓、炙甘草）加减。【中成药应用】常用中成药有十一味参芪胶囊、参芪十一味颗粒。（二）血虚证：【方剂应用】基础方剂为四物汤（熟地黄、当归、川芎、芍药）加减（A错）。【中成药应用】常用中成药有归芪口服液、再造生血片、薯蓣丸。（三）阴虚证：【中成药应用】常用中成药有人参固本丸（大蜜丸）、河车大造丸。（四）阳虚证：【中成药应用】常用中成药有补白颗粒。四神丸（B错）为泄泻肾阳虚衰证的中成药应用。泄泻脾阳虚衰证：【中成药应用】常用中成药有四神丸、桂附理中丸、固本益肠片、肠胃宁片。龟鹿二仙膏（D错）：【功能】温肾补精，补气养血。【主治】肾虚精亏所致的腰膝酸软、遗精、阳痿。六味地黄丸（E错）为消渴肾阴亏虚证的中成药应用。消渴肾阴亏虚证：【中成药应用】常用中成药有六味地黄丸（水蜜丸）、麦味地黄丸（水蜜丸）。